进入体内经过生物转化可使其毒性增强的污染物是
A. SO₂
B. CO₂
C. BaP
D. DDT
E. Pb

正确答案：C。BaP

解析：本题考查污染物的生物转化。BaP（苯并芘）（C对ABDE错）是一种污染物，它可以通过空气、水和土壤进入人体，并在体内经过生物转化，使其毒性增强。